关于新生儿颅的叙述，正确的是
A. 鼻旁窦不发达
B. 后囟在生后1~2岁闭合
C. 前囟呈菱形，生后不久闭合
D. 脑颅比面颅小
E. 无

正确答案：A。鼻旁窦不发达

解析：胎儿时期由于脑及感觉器官发育早，而咀嚼和呼吸器官，尤其是鼻旁窦尚不发达（A对），因此脑颅远大于面颅（D错）。前囟（额囟）最大，呈菱形，位于矢状缝与冠状缝相接处，前囟在生后 1 -2 岁时闭合（B错），其余各囟均于生后不久闭合（C错）。